高渗性脱水患者可表现有
A. 尿少
B. 低容量性休克
C. 两者均有
D. 两者均无
E. 无

正确答案：A。尿少

解析：高渗性脱水时失水大于失钠，细胞外液渗透压升高，ADH分泌增加，肾小管重吸收水增多引起尿少（A对）。血容量下降可反射性地引起醛固酮分泌增加，它与ADH一起有助于维持细胞外液容量和循环血量，使其不致下降太多，同时细胞内水向渗透压高的细胞外转移，有助于细胞外液量恢复，故高渗性脱水患者一般不伴低容量性休克（B错）。